膳食铁的最好来源是
A. 畜、禽、鱼类
B. 豆类
C. 粮谷类
D. 蔬菜类
E. 水果类

正确答案：A。畜、禽、鱼类